与慢性牙周炎关系最密切的是
A. 伴放线聚集杆菌
B. 中间普氏菌
C. 螺旋体
D. 丝状菌
E. 牙龈卟啉单胞菌

正确答案：E。牙龈卟啉单胞菌

解析：本题考查各型牙周病有关的致病菌。与慢性牙周炎关系最密切的是牙龈卟啉单胞菌（E对）。局限性侵袭性牙周炎的主要致病菌为伴放线聚集杆菌（A错）；妊娠期龈炎有关致病菌为中间普氏菌（B错）；坏死性溃疡性龈炎的相关致病菌为齿垢密螺旋体（C错）；与龋病和龈上牙石形成有关的细菌是丝状菌（D错）；慢性牙周炎的主要致病菌为牙龈卟啉单胞菌。